增生的牙龈造成移位的牙齿多见于
A. 下颌前牙
B. 上颌前磨牙
C. 上颌磨牙
D. 上颌前牙
E. 下颌前磨牙

正确答案：D。上颌前牙

解析：增生的牙龈还可将牙齿挤压移位，这种情况多见于上前牙。掌握“药物性牙龈肥大”知识点。